女，55岁。皮肤黄染进行性加重1个月，10天前发现小便呈浓茶样，近几天大便呈灰白色，查体：T36.8℃，皮肤巩膜黄染，腹软，右上腹可触及肿大的胆囊，无压痛，无反跳痛。最可能的诊断是
A. 胆总管结石
B. 肝细胞性肝癌
C. 肝门部胆管癌
D. 胆囊结石
E. 胰头癌

正确答案：E。胰头癌

解析：中年女性患者，进行性黄疸1个月，大便呈灰白色（提示胆道完全梗阻），查体见皮肤巩膜黄染，胆囊肿大，无压痛、反跳痛（Courvoisier征，提示胰头癌），结合患者病史、体查，最可能的诊断是胰头癌（E对）。胰头癌浸润或压迫胆总管可导致胆汁下行受阻，胆汁淤积引起黄疸及胆囊肿大；由于胰头癌所致的胆道梗阻一般无胆道感染，故胆囊多无触、压痛。胆总管结石（P440）（A错）平时一般无症状或仅有上腹不适，继发感染时可出现典型的Charcot三联征，即腹痛、寒战高热、黄疸，查体可有胆囊触压痛。肝细胞性肝癌（P418）（B错）主要表现为肝区疼痛、乏力、消瘦、腹胀、食欲减退等症状，查体多可触及质硬、边缘不规则的肝脏，晚期可出现黄疸，但无胆囊增大。肝门部胆管癌（P453）（C错）主要表现为黄疸及肝脏肿大，因癌肿位置较高，胆囊一般不增大，甚至出现缩小。胆囊结石（P439）（D错）主要表现为高脂饮食后出现右上腹阵发性绞痛，可有恶心、呕吐，极少引起黄疸。